关于慢性支气管炎实验室检验错误的是
A. 白细胞总数升高
B. 中性粒细胞升高
C. 痰培养无菌
D. 早期胸部X线检查可无异常
E. 早期呼吸功能检查可无异常

正确答案：C。痰培养无菌

解析：慢性支气管炎实验室检查：①血常规：细菌感染时白细胞总数和中性粒细胞可升高。②痰：合格痰标本培养可培养出致病菌。③胸部X线检查：早期可无异常。随病程进展出现肺纹理增粗、紊乱、网状或条索状，斑点状阴影，以双下肺明显。④呼吸功能检查：早期可无异常，或仅有小气道阻塞，表现为最大呼气流速容量曲线在75%和50%肺容量时，流量明显降低。掌握“慢性支气管炎”知识点。